患者，女,30岁，左颈部核桃大小卵圆形肿物，不红，不热，随吞咽上下移动，舌苔白腻。脉弦，治疗应首选的方剂是
A. 逍遥散合栝楼牛蒡汤
B. 逍遥散合海藻玉壶汤
C. 四海舒郁丸
D. 逍遥蒌贝散
E. 柴胡疏肝散合栝楼牛蒡汤

正确答案：C。四海舒郁丸

解析：本病为瘿病，病人颈部肿块，能上下移动，苔白腻，为气郁痰阻，用四海舒郁丸（C对）。栝楼牛蒡汤主治妇人乳房结块肿痛（AE错）海藻玉壶汤理气化痰消瘿，养血活血，而此病人无瘀血表现（B错），逍遥蒌贝散主治乳癖、瘰疬、乳癌初起等病症（D错）。